承担职业病诊断的机构进行职业病诊断时，应当组织几名取得职业病诊断资格的执业医师集体诊断
A. 2名
B. 3名
C. 2名以上
D. 3名以上
E. 4名以上

正确答案：D。3名以上